城市规划的基本原则有：确定城市性质，控制城市规模；远期规划与近期规划结合，总体规划与详细规划结合；以及
A. 保护城市生态环境
B. 维护城市文明，改善景观环境
C. 加强安全防患，促进人际交往
D. 以上都不是
E. 以上都是

正确答案：E。以上都是

解析：本题考查城市规划卫生的基本原则。城市规划卫生的基本原则包括：1.确定城市性质，控制城市规模；2.远期规划与近期规划相结合，总体规划与详细规划相结合；3.保护城市生态环境；4.维护城市文脉，改善景观环境；5.加强安全防患，促进人际交往（E对ABCD错）。